关于单纯疱疹病毒（HSV）感染的说法，错误的是
A. 对生殖器HSV感染的产妇，宜行剖宫产，以避免分娩时感染胎儿
B. 使用安全套是降低生殖器HSV-2传播风险的有效手段
C. HSV感染与癌症发病相关
D. HSV可潜伏在人体多种器官内
E. 可接种HSV疫苗进行预防

正确答案：C。HSV感染与癌症发病相关

解析：本题考查单纯疱疹病毒（HSV）感染。HSV感染与癌症发病无关（C错，为本题正确答案）。新生儿及免疫功能低下者应尽可能避免接触HSV感染者。对生殖器HSV感染的产妇，宜行剖宫产，以避免分娩时感染胎儿（A对）。HSV是双股DNA病毒，分为HSV-1和HSV-2，1型主要侵犯面部皮肤黏膜、脑及腰以上部位，2型主要侵犯生殖器、肛门等部位及新生儿感染，并非可潜伏在人体的多种器官（D对）。使用安全套是降低生殖器HSV-2传播风险的有效手段（B对）。可选用HSV疫苗进行预防接种（E对）。